患者，男，25岁。发热，咳嗽3天。检查：气管位置居中，右胸呼吸动度减弱，右中肺语颤增强，叩诊呈浊音，听诊可闻及湿性啰音及支气管肺泡呼吸音。应首先考虑的是
A. 胸膜炎
B. 肺炎
C. 气胸
D. 肺不张
E. 肺结核

正确答案：B。肺炎

解析：患者青年男性，发热，咳嗽3天。检查：气管位置居中，右胸呼吸动度减弱，右中肺语颤增强，叩诊呈浊音，听诊可闻及湿性啰音及支气管肺泡呼吸音，患者临床表现与肺炎肺实变期相符，故患者最可能的诊断是肺炎（B对）。胸膜炎（A错）主要表现为胸痛、咳嗽、胸闷、气急及呼吸困难。气胸（P122）（C错）主要表现为突发性胸痛，继而出现胸闷和呼吸困难，并可有刺激性咳嗽。肺不张（D错）主要表现为患侧明显的疼痛、突发呼吸困难、发绀，甚至出现血压下降、心动过速、发热，偶可引起休克。肺结核（P64）（E错）主要表现为咳嗽、咳痰或痰中带血，伴有乏力、低热、盗汗等。